流行性出血热患者全身各组织器官都可有充血、出血、变性、坏死，表现最为明显的器官是
A. 心
B. 肺
C. 肾
D. 脑垂体
E. 胃肠

正确答案：C。肾

解析：流行性出血热患者全身各组织器官都可有充血、出血、变性、坏死，表现最为明显的器官是小血管和肾（C对），肾脏肉眼可见肾脂肪囊水肿、出血，肾皮质苍白，肾髓质极度充血并有出血和水肿，镜检肾小球充血，基底膜增厚等。其次为心、肝、脑等脏器。